锁骨
A. 由膜化骨形成
B. 外侧1/3凸向前
C. 内侧端扁平
D. 与胸骨构成关节
E. 中、内1/3交界处易骨折

正确答案：D。与胸骨构成关节

解析：锁骨有关节面与胸骨柄相关节（D对）。锁骨内侧 2/3 凸向前（B错），呈三棱形，外侧 1/3 凸向后，呈扁平形（C错）。锁骨中外1/3交界处易骨折（E错）。